裂体细胞的产生是因为
A. 微血管内微血栓形成
B. 纤维蛋白丝在微血管腔内形成细网
C. 异型输血
D. 微循环血液泥化淤滞
E. 微血管内皮细胞受损

正确答案：B。纤维蛋白丝在微血管腔内形成细网

解析：纤维蛋白丝在微血管腔内形成细网（B对ACDE错），当血流中的红细胞通过网孔时，被黏着、滞留或挂在纤维蛋白丝上，然后这些红细胞在血流不断的冲击下发生破裂，其外形呈盔形、星形、新月形等，统称为裂体细胞或红细胞碎片。微血管内微血栓形成（A错）、异型输血（C错）、微循环血液泥化淤滞（D错）、微血管内皮细胞受损（E错）不是裂体细胞的产生的原因。